根据《药品说明书和标签管理规定》，含有化学药品的中药复方制剂，其处方药说明书中应注明“本品含××化学药品通用名称”的药品说明书项目是
A. 【警示语】
B. 【禁忌】
C. 【规格】
D. 【药品名称】

正确答案：A。【警示语】

解析：本题考查药品说明书的格式和书写要求。根据《药品说明书和标签管理规定》，含有化学药品的中药复方制剂，其处方药说明书中应注明“本品含××化学药品通用名称”的药品说明书项目是【警示语】（A对）。【警示语】：“警示语”是指对药品严重不良反应及其潜在的安全性问题的警告，还可以包括药品禁忌、注意事项及剂量过量等需提示用药人群特别注意的事项。有该方面内容的，应当在说明书标题下以醒目的黑体字注明。无该方面内容的，不列该项。含有化学药品（维生素类除外）的中药复方制剂，应注明本品含××（化学药品通用名称）。【禁忌】（B错）：（1）处方药应当列出该药品不能应用的各种情况，例如禁止应用该药品的人群、疾病等情况；尚不清楚有无禁忌的，可在该项下以“尚不明确”来表述。（2）预防用生物制品列出禁止使用或者暂缓使用该制品的各种情况。（3）非处方药应列出该药品不能应用的各种情况，如禁止应用该药品的人群或疾病等情况。国家药品监督管理部门公布的该药品禁忌内容不得删减。【禁忌】内容应采用加重字体印刷。【规格】（C错）：（1）化学药品和治疗用生物制品指每支、每片或其他每一单位制剂中含有主药（或效价）的重量或含量或装量。生物制品应标明每支（瓶）有效成分的效价（或含量及效价）及装量（或冻干制剂的复溶后体积）。表示方法一般按照中国药典要求规范书写，有两种以上规格的应当分别列出。（2）中药、天然药物处方药应与国家批准的该品种药品标准中的规格一致。同一药品生产企业生产的同一品种，如规格或包装规格不同，应使用不同的说明书。（3）化学药品非处方药指每支、每片或其他每一单位制剂中含有主药的重量、含量或装量。生物制品应标明每支（瓶）有效成分效价（或含量）及装量（或冻干制剂的复溶体积）。计量单位必须以中文表示。每一说明书只能写一种规格。（4）中成药非处方药应与药品标准一致。数字以阿拉伯数字表示，计量单位必须以汉字表示。每一说明书只能写一种规格。（5）预防用生物制品应明确该制品每1次人用剂量及有效成分的含量或效价单位，及装量（或冻干制剂的复溶后体积）。【药品名称】（D错）按下列顺序列出：（1）通用名称：中国药典收载的品种，其通用名称应当与药典一致；或者与国家批准的该品种药品标准中的药品名称一致；药典未收载的品种，其名称应当符合药品通用名称命名原则。（2）商品名称：未批准使用商品名称的药品不列该项。（3）英文名称：无英文名称的药品不列该项。（4）汉语拼音。